治疗要获得病人的知情同意，其实质是
A. 尊重患者自主性
B. 尊重患者社会地位
C. 尊重患者人格尊严
D. 患者不会做出错误决定
E. 患者提出的要求总是合理的

正确答案：A。尊重患者自主性

解析：治疗之前获得病人的知情同意的实质是尊重患者的自主性。掌握“医患关系伦理”知识点。